突然发作突然终止，按摩颈动脉窦可终止发作，最可能的是
A. 心房扑动
B. 心房颤动
C. 窦性心动过速
D. 阵发性室上性心动过速
E. 持续性室性心动过速

正确答案：D。阵发性室上性心动过速

解析：阵发性室上性心动过速简称室上速。大多数心电图表现为QRS波形态正常、RR间期规则的快速心律。心动过速发作突然起始与终止，持续时间长短不一。急性发作期的患者可尝试刺激迷走神经治疗，包括劲动脉窦按摩（患者取仰卧位，先行右侧，每次5～10秒，切莫双侧同时按摩）、诱导恶心、将面部浸没于冰水内等。故本题最可能的是阵发性室上性心动过速（D对）。心房扑动（A错）和心房颤动（B错）一般为阵发性发作，可自行终止，按摩颈动脉窦对其无多大作用。窦性心动过速（P182）（C错）通常逐渐开始和终止，按摩颈动脉窦可使其频率逐渐减慢，停止刺激后又加速至原先水平。持续性室性心动过速（P198）（E错）（发作时间超过30秒，需药物或电复律始能终止）常伴有明显血流动力学障碍与心肌缺血，按摩颈动脉窦对其无效。